女，22岁，在读大学生。于半年前觉得其身材不够苗条，开始极端地限制饮食，每餐只吃蔬菜、水果及极少量米饭。喝水较少，称水喝多了会浮肿。体型日渐消瘦，但其仍认为偏胖。近1个月暴饮暴食，进食后为避免体重反弹而自行催吐，每周4～5次，并出现失眠，整夜难以入睡，情绪低落，不能坚持上课。对患者的治疗措施不包括
A. 电抽搐治疗
B. 认知行为治疗
C. 抗抑郁药物治疗
D. 躯体支持治疗
E. 小剂量抗精神病药物治疗

正确答案：A。电抽搐治疗

解析：成年女性患者，存在故意限制能量摄入、体像障碍、担心体重增加或变胖、间歇发作的暴饮暴食、病程持续3个月以上，综合患者的症状、体征和辅助检查，初步诊断为神经性厌食。对患者的治疗措施不包括电抽搐治疗（A错，为本题正确答案）。认知行为治疗（B对）为心理治疗。抗抑郁药物治疗（C对）、小剂量抗精神病药物治疗（E对）可改善患者的抑郁、焦虑情绪、强迫和体像障碍。由于患者体重下降出现严重的营养不良，所以需行躯体支持治疗（D对）以纠正营养不良以及由于营养不良所带来的水电解质平衡紊乱，给予足够维持生命的能量，以挽救患者生命。